谷类食物中的碳水化合物主要是
A. 葡萄糖
B. 麦芽糖
C. 淀粉
D. 果糖
E. 纤维素

正确答案：C。淀粉